白扁豆除健脾化湿外，又能
A. 止血续伤
B. 消暑解毒
C. 活血散结
D. 清火生津
E. 润肺化痰

正确答案：B。消暑解毒

解析：本题考查的是白扁豆的功效。白扁豆除健脾化湿外，又能消暑解毒（B对）。白扁豆：【功效】健脾化湿，消暑解毒。续断：【功效】补肝肾，行血脉，续筋骨（A错）。海马：【功效】补肾助阳，活血散结（C错），消肿止痛。西洋参：【功效】补气养阴，清热生津（D错）。瓜蒌：【功效】清肺润燥化痰（E错），利气宽胸，消肿散结，润肠通便。